回力卡环具有应力中断作用
A. 因为远中（牙合）支托与基托相连，（牙合）力通过支托传导到基牙，减轻了牙槽嵴的负担
B. 因为远中（牙合）支托与基托相连，（牙合）力通过人工牙和基托传导到牙槽嵴，减轻了基牙的负担
C. 因为远中（牙合）支托不与基托相连，（牙合）力通过支托传导到基牙，减轻了牙槽嵴的负担
D. 因为远中（牙合）支托不与基托相连，（牙合）力通过人工牙和基托传导到牙槽嵴，减轻了基牙的负担
E. 因为远中（牙合）支托不与基托相连，（牙合）力通过人工牙和基托传导到牙槽嵴，加重了牙槽嵴的负担

正确答案：D。因为远中（牙合）支托不与基托相连，（牙合）力通过人工牙和基托传导到牙槽嵴，减轻了基牙的负担

解析：本题考查回力卡环的应力中断作用。回力卡环远中（牙合）支托不与基托相连，就是为了不让所受（牙合）力传导到基牙上，减轻基牙的受力，保护基牙健康（D对）。